患者夜寐盗汗，五心烦热，两颧色红口渴，舌红少苔，脉细数。治疗应首选
A. 黄连阿胶汤
B. 黄连温胆汤
C. 当归六黄汤
D. 养阴清肺汤
E. 甘麦大枣汤

正确答案：C。当归六黄汤

解析：阴精亏虚，虚火内生，热逼津液外泄，故夜寐盗汗；虚热内蒸，故五心烦热，两颧色红；阴虚有热而津液不足，故口渴；舌红少苔，脉细数，为阴虚火旺之象，故诊断为阴虚火旺证，治以滋阴降火，代表方为当归六黄汤（C对）。黄连阿胶汤，其功用为滋阴降火安神，适用于心肾不足，阴虚火旺较重的心烦失眠，舌红苔燥，脉细数者（A错）。黄连温胆汤，其功用为不寐之痰火扰心证(B错)。养阴清肺汤，其功用为养阴清肺，解毒利咽，适用于白喉之阴虚燥热证（D错）。甘麦大枣汤，其功用为养心安神，和中缓解，适用于脏躁（E错）。